分子中含有环氧基，对中枢具有较强作用的药物是
B. 硫酸阿托品
C. 氢溴酸东莨菪碱
D. 氢溴酸山莨菪碱
E. 丁溴东莨菪碱

正确答案：C。氢溴酸东莨菪碱

解析：本题考查药物的化学结构及药理作用。分子中含有环氧基，对中枢具有较强作用的药物是氢溴酸东莨菪碱（C对）。氢溴酸东莨菪碱是一种外周作用较强的抗胆碱药，能阻断M胆碱受体，对神经系统有较强的抑制作用，具有环氧基结构。氢溴酸后马托品（A错）、硫酸阿托品（B错）、氢溴酸山莨菪碱（D错）、丁溴东莨菪碱（E错）都是抗胆碱药，但不具有环氧基结构。